组织中有油室的药材是
A. 五味子
B. 小茴香
C. 枳壳
D. 枸杞子
E. 山茱萸

正确答案：C。枳壳

解析：本题考查的是枳壳的显微鉴别。组织中有油室的药材是枳壳（C对）。枳壳【显微鉴别】粉末：黄白色或棕黄色。①果皮表皮细胞多角形、方形或狭长，直径16～34㎛；气孔类圆形，副卫细胞5～9个；表皮下层细胞多含草酸钙方晶。②中果皮薄壁细胞不均匀增厚，壁厚8～16㎛。③瓤囊表皮细胞狭长，微波状弯曲或皱缩成线形，其下层细胞含方晶。④草酸钙方晶呈多面形，类双锥形或类斜方形，长3～30㎛。⑤可见油室碎片，含挥发油滴。⑥导管为螺纹、网纹，管胞细小。五味子（A错）【显微鉴别】粉末五味子、醋五味子：种皮表皮石细胞淡黄棕色，表面观类多角形，直径18～50㎛，壁较厚，孔沟细密，胞腔含暗棕色物。种皮内层石细胞呈多角形、类圆形或不规则形，直径约至83㎛，壁稍厚，纹孔较大。果皮表皮细胞表面观类多角形，垂周壁略呈连珠状增厚，表面有角质线纹，表皮中散有油细胞。小茴香（B错）【显微鉴别】粉末：绿黄色或黄棕色。①网纹细胞壁厚，木化，具卵圆形网状壁孔。②油管显黄棕色至深红棕色，常已破碎。分泌细胞呈扁平多角形。③镶嵌状细胞为内果皮细胞，5～8个狭长细胞为1组；以其长轴相互作不规则方向嵌列。④内胚乳细胞多角形，无色，壁颇厚，含多数直径约10㎛的糊粉粒，每一糊粉粒中含细小簇晶1个，直径约7㎛。枸杞子（D错）【显微鉴别】粉末：黄橙色或红棕色。①外果皮细胞多角形，表面具平行的微波状角质层纹理。②中果皮薄壁细胞类多角形，胞腔内含红棕色或橙红色球形颗粒，有的含砂晶。③种皮石细胞不规则多角形，壁厚，垂周壁深波状或微波状弯曲。山茱萸（E错）粉末：红褐色。①果皮表皮细胞表面观多角形或长方形，垂周壁连珠状增厚，外平周壁颗粒状角质增厚，胞腔含淡橙黄色物。②中果皮细胞橙棕色，多皱缩。草酸钙簇晶少数。③石细胞类方形、卵圆形或长方形、纹孔明显，胞腔大。